小儿脊柱出现胸椎后凸在
A. 出生后2个月
B. 出生后3个月
C. 出生后6个月
D. 出生后8个月
E. 出生后10个月

正确答案：C。出生后6个月

解析：小儿出生时脊柱无弯曲，仅呈轻微后凸。由于6个月（C对）后能坐，出现胸椎后凸。